重症急性胰腺炎患者出现血压下降，给予快速补液后，患者可出现的临床表现是
A. 动脉血压升高，尿量减少
B. 动脉血压降低，尿量减少
C. 动脉血压升高，尿量增加
D. 动脉血压降低，尿量增加
E. 动脉血压和尿量无明显变化

正确答案：C。动脉血压升高，尿量增加

解析：重症急性胰腺炎患者虽血压下降，但给予快速补液，有效循环血容量得到补充，属于休克代偿期。因此，患者可出现的临床表现为动脉血压升高。动脉血压上升，导致肾有效灌注压增加，则表现为尿量增加（C对）。